中医认为异位妊娠的病因病机是
A. 冲脉气滞血瘀
B. 气滞、血瘀、血虚、虚寒，以致胞脉胞络阻滞失养
C. 少腹素有瘀滞，冲任胞络不畅
D. 冲任损伤，胎元不固
E. 脾胃虚弱，土不制水，水渍胞中

正确答案：C。少腹素有瘀滞，冲任胞络不畅

解析：异位妊娠的病因病机是少腹瘀滞、胎胎阻胞络（C对）。冲脉气滞血瘀（A错）为月经后期的常见证型。胞脉胞络阻滞失养（B错）可使月经紊乱，无胎阻之象。冲任损伤，胎元不固（D错）是流产的病机。脾虚水泛胞中（E错）为卵巢囊肿病因。